患者两眼红肿疼痛，眵多，畏光流泪兼见头痛，发热，脉浮数针灸治疗宜
A. 少商上星毫针泻法
B. 内庭曲池毫针泻法
C. 少商太阳点刺出血
D. 行间侠溪点刺出血
E. 外关中渚点刺出血

正确答案：C。少商太阳点刺出血

解析：患者两眼红肿疼痛，眵多，畏光流泪兼见头痛，发热，脉浮数，诊为外感风热导致的目赤肿痛。治宜疏风散热，消肿止痛，主穴选用睛明、太阳、风池、合谷、太冲，配以少商、外关。操作方法为毫针泻法，太阳、少商点刺放血。少商为肺经井穴，点刺出血主治咽喉肿痛、咳嗽、气喘、鼻衄、发热等。太阳点刺放血主治头痛、目疾、面瘫（C对）。